TNF代表的细胞因子是
A. 肿瘤坏死因子
B. 干扰素
C. 集落刺激因子
D. 白细胞介素
E. 红细胞生成素

正确答案：A。肿瘤坏死因子